收缩时可作张口运动
A. 颞肌
B. 咬肌
C. 颧肌
D. 翼内肌
E. 翼外肌

正确答案：E。翼外肌

解析：颞肌（A错）、咬肌（B错）和翼内肌（D错）上提下颌骨（闭口），使下颌骨向前或向后运动。颧肌（C错）提上唇与口角。翼外肌（E对）两侧同时收缩作张口运动，一侧收缩使下颌移向对侧。